可减少酸性饮料对牙侵蚀
A. 服维生素C
B. 饭后刷牙
C. 窝沟封闭
D. 护牙托
E. 用吸管饮用饮料

正确答案：E。用吸管饮用饮料

解析：本题考查酸蚀症的预防。可减少酸性饮料对牙侵蚀的是用吸管饮用饮料（E对）。用吸管饮用可减少酸性饮料接触牙面的时间。服维生素C（A错）可预防坏血病、传染病、紫癜等。饭后刷牙（B错）会刮掉牙釉质、帮助酸性物质扩散、出现牙本质过敏症，对牙齿健康不利。窝沟封闭（C错）可增强牙对龋病抵抗力。护牙托（D错）可预防运动中牙外伤。